关于能量消耗，下列叙述正确的是
A. 体力活动的能量消耗是人体主要的能量消耗
B. 儿童一日的能量消耗包括基础代谢、食物热效应
C. 食物热效应消耗与能量进食速度、进食量有关，与膳食构成无关
D. 基础代谢的能量消耗受体表面积、生理病理状况和环境的影响
E. 以上都不对

正确答案：D。基础代谢的能量消耗受体表面积、生理病理状况和环境的影响

解析：本题考查能量代谢的特点。基础代谢是人体主要的能量消耗，受体表面积、生理病理状况和环境的影响（D对E错）。儿童一日的能量消耗包括：基础代谢、体力活动（A错）、食物特殊动力学效应和提供生长发育所需的能量（B错），食物热效应与进食速度、进食量、膳食构成均有关（C错）。